下列降压药物中便秘发生率最高的药物是
A. 硝苯地平
B. 维拉帕米
C. 氯沙坦
D. 普萘洛尔
E. 卡托普利

正确答案：B。维拉帕米